薄荷在逍遥散中的作用是
A. 疏散肺经风热
B. 透达肝经郁热
C. 辛凉散邪利咽
D. 清利头目利咽
E. 辛凉解表疏肝

正确答案：B。透达肝经郁热

解析：薄荷辛凉，归肺、肝经，其功效为疏散风热，清利头目，利咽透疹，疏肝行气。逍遥散功能疏肝解郁，养血健脾，其中加薄荷少许透达肝经之郁热（B对）。